中医强调辨证论治，不同疾病出现相同的证候可以采用相同的治疗方法。适合应用归脾丸治疗的疾病有
A. 郁证
B. 眩晕
C. 不寐
D. 泄泻
E. 崩漏

正确答案：A、B、C、E。郁证；眩晕；不寐；崩漏

解析：本题考查的是中医内科病证的辨证论治。适合应用归脾丸治疗的疾病有郁证（A对）、眩晕（B对）、不寐（C对）与崩漏（E对）。眩晕气血亏虚证：【中成药应用】常用中成药有归脾丸（大蜜丸）、益中生血片、参茸阿胶。郁证心脾两虚证：【中成药应用】常用中成药有：归脾丸可用于郁证之心脾两虚证见气短心悸，失眠多梦，头昏头晕，肢倦乏力，食欲不振，崩漏便血者。人参归脾丸可用于郁证之心脾两虚证见心悸，怔忡，失眠健忘，食少体倦，面色萎黄者。不寐心脾两虚证：【中成药应用】常用中成药有归脾丸、人参归脾丸。